不是非离子表面活性剂的是
A. 脂肪酸单甘脂
B. 聚山梨酯
C. 泊洛沙姆
D. 苯扎氯铵
E. 蔗糖脂肪酸酯

正确答案：D。苯扎氯铵

解析：本题考查表面活性剂。苯扎氯胺（D错，为本题正确答案）为阳离子表面活性剂；脂肪酸单甘脂（A对）、聚山梨酯（B对）、泊洛沙姆（C对）、蔗糖脂肪酸酯（E对）等均为非离子表面活性剂。